夜盲症患者可以使用的治疗药物是
A. 维生素A
B. 维生素D
C. 维生素B₁
D. 维生素B₂
E. 维生素B₆

正确答案：A。维生素A

解析：本题考查维生素A。维生素A（A对）用于防治维生素A缺乏症，如夜盲症。维生素D（B错）能够促进人体吸收钙、磷。维生素B₁（C错）用于维生素B₁缺乏所致的脚气病或韦尼克脑病的治疗。维生素B₂（D错）用于防治维生素B₂缺乏症，如口角炎、唇干裂等。维生素B₆（E错）用于维生素B₆缺乏的预防和治疗，如脂溢性皮炎、口唇干裂。